男，35岁。体检发现血压150/120mmHg，血钾2.8mmol/L。腹部CT检查发现右肾上腺1.0cm的低密度占位病变，拟手术治疗。术前准备首选的药物是
A. 托拉塞米
B. 呋塞米
C. 氨苯蝶啶
D. 螺内酯
E. 氢氯噻嗪

正确答案：D。螺内酯

解析：中年男性，血压150/120mmHg（正常值120/80mmHg），血钾2.8mmol/L（正常值3.5～5.5 mmol/L）（高血压、低血钾最常见的原因为原发性醛固酮增多症），腹部CT检查发现右肾上腺1.0cm的低密度占位病变（提示可能为肾上腺皮质腺瘤，最常见的病因，约占原醛症80%），可诊断为原发性醛固酮增多症，术前准备首选醛固酮竞争性拮抗剂螺内酯（安体舒通）（D对）。托拉塞米是一种高效髓袢利尿剂，用于充血性心力衰竭、肝硬化腹水、肾脏疾病所致的水肿患者（A错）。呋塞米（速尿），是一种广泛应用于治疗充血性心力衰竭和水肿的袢利尿药（B错）。氨苯蝶啶是潴钾利尿剂，用于治疗各类水肿，作为原发性醛固酮增多症的术前准备用药，但效果不如螺内酯，因此不作为首选（C错）。氢氯噻嗪主要适用于心源性水肿，肝源性水肿和肾性水肿等，无拮抗醛固酮作用（E错）。